从同一个总体中随机抽出观察数相等的多个样本，样本率与总体率、各样本率之间往往会有差异，这种差异被称为
A. 统计偏倚
B. 计数偏倚
C. 率的抽样误差
D. 测量误差
E. 计算误差

正确答案：C。率的抽样误差

解析：从同一个总体中随机抽出观察数相等的多个样本，样本率与总体率、各样本率之间往往会有差异，这种差异被称为率的抽样误差。掌握“分类资料的统计描述与推断”知识点。